关于患者享有平等医疗权利的表述中错误的是
A. 公民享有生命健康权
B. 对所有患者都应一视同仁
C. 患者的需求应得到完全满足
D. 患者享有的医疗保健权在实现时是受条件限制的
E. 应满足患者的合理需求

正确答案：C。患者的需求应得到完全满足

解析：平等的医疗权是指任何患者的医疗保健享有权都是平等的，在医疗中都享有得到基本的、合理的诊治和护理的权利，在医务人员面前，患者是平等的。医务人员对待患者应一视同仁，对他们的正当愿望及合理要求都应在力所能及的条件下，尽量给予满足。平等的医疗权体现在患者应医过程中的各个环节。掌握“医患关系伦理”知识点。